某妇女下腹部疼痛，阴道有大量黄色、无血、无气味的分泌物，一周前曾做过经阴道结扎术。检查时，从阴道后穹隆穿刺为20ml带血、恶臭的脓性物，厌氧培养出G-杆菌。请问该化脓感染的病原体可能是下列哪项
A. 大肠埃希菌
B. 铜绿假单胞菌
C. 变形杆菌
D. 脆弱类杆菌
E. 肉毒杆菌

正确答案：D。脆弱类杆菌

解析：无芽胞厌氧菌：脆弱类杆菌。在临床感染病例的标本中以脆弱类杆菌分离率最高，在厌氧菌菌血症病例中，本菌的分离率高达50%～90%，阑尾炎病例中占25%～90%，在肺和胸膜感染中占26%，还可引起颅内感染、阴道及盆腔感染等。掌握“无芽胞厌氧菌”知识点。